肾性贫血宜选用
A. 硫酸亚铁
B. 叶酸
C. 维生素B₁₂
D. 重组人促红素
E. 腺嘌呤

正确答案：D。重组人促红素

解析：本题考查重组人促红素。肾性贫血主要由于肾脏、肝脏产生的内源性重组人促红素生成不足引起的。重组人促红素（D对）可用于外源性补充。硫酸亚铁（A错）用于防治各种原因引起的缺铁性贫血。叶酸（B错）可用于各种原因引起的叶酸缺乏及叶酸缺乏所致的巨幼红细胞贫血。维生素B₁₂（C错）用于巨幼红细胞贫血，改善神经损伤症状。腺嘌呤（E错）用于防治各种原因引起的白细胞减少症，急性中性粒细胞减少症。